阴寒内盛，血行瘀滞的舌象表现是
A. 舌淡红润泽
B. 舌红绛少苔
C. 舌绛紫而干
D. 舌淡白光莹
E. 舌淡紫湿润

正确答案：E。舌淡紫湿润

解析：阴寒内盛，此为阴邪，未伤津液，故舌苔偏湿润；血行瘀滞，舌体气血运行不畅，故舌色偏青紫。因此，阴寒内盛，血行瘀滞，可见舌淡紫湿润（E对）。舌淡红润泽，为气血调和的征象，常见于正常人，若病中见之，则多属病轻（A错）。舌绛少苔，多属久病阴虚火旺，或热病后期阴液耗损所致（B错）。舌绛紫而干，多为热毒炽盛，内入营血，营阴受灼，津液耗损，气血壅滞所致（C错）。舌淡白光莹，舌体痩薄，多属气血两虚（D错）。